制取全口义齿印模，以下叙述哪项不正确
A. 使组织受压均匀
B. 适当伸展印模范围
C. 采取解剖式印模
D. 保持稳定的位置
E. 做肌功能修正

正确答案：C。采取解剖式印模

解析：全口义齿印模要求：①精确地组织解剖形态，对于活动度大的松软牙槽嵴黏膜，也应缓冲压力，防止其变形；②适度的伸展范围，在不影响口周组织的正常活动下，应尽量扩大印模的范围；③周围组织的功能形态，选择功能性印模，并在印模材可塑期内进行边缘整塑，义齿基托边缘既不会妨碍周围组织的功能运动，又能形成良好的边缘封闭，有利于义齿的固位。掌握“无牙颌的印模与模型”知识点。